患者女性，38岁，发热4天，体温38℃，两膝关节肿痛，行动不便，下肢沉重酸胀，伴饮食无味，纳呆，偶有恶心呕吐，全身困乏无力，下肢浮肿，在某医院诊为类风湿关节炎，舌苔黄腻，脉滑数。其治疗的代表方剂是
A. 丁氏清络饮加减
B. 四妙丸加减
C. 桂枝芍药知母汤加减
D. 独活寄生汤加减
E. 身痛逐瘀汤加减

正确答案：B。四妙丸加减

解析：外感风湿热邪则发热，或风寒湿痹，郁久化热，痹阻经络关节，则两膝关节肿痛，行动不便，下肢沉重酸胀；久病而致脾虚，湿热蕴结则饮食无味，纳呆，偶有恶心呕吐，全身困乏无力，下肢浮肿，苔黄腻，脉滑数，治宜清热通络，祛风除湿，用四妙丸加减（B对）。丁氏清络饮加减类风湿性关节炎湿热毒盛型（A错）十版删除此证。桂枝芍药知母汤加减一般用来治寒热错杂之痹（C错）。独活寄生汤加减一般用来治肝肾两虚证，用其补益肝肾，舒筋活络（D错）。身痛逐瘀汤（E错）加减一般用来治痰瘀互结证，用其活血化瘀，祛痰通络，须配合指迷茯苓丸。